属于药物制剂的物理配伍变化的有
A. 结块
B. 变色
C. 产气
D. 潮解
E. 液化

正确答案：A、D、E。结块；潮解；液化

解析：本题考查药物的配伍变化。结块（A对）、潮解（D对）和液化（E对）是药物制剂的物理配伍变化；变色（B错）、产气（C错）是化学配伍变化。